急性蜂窝织炎发展至脓肿已有波动反应时，应采用的治疗方法是
A. 大量抗生素治疗
B. 外敷药物等待穿破
C. 切开引流
D. 穿刺抽脓液、腔内注射抗生素
E. 等待自然吸收或破溃

正确答案：C。切开引流

解析：蜂窝织炎的局部处理：早期一般性蜂窝织炎，可药膏敷贴等，若病变进展，形成脓肿应切开引流。掌握“软组织急性感染”知识点。